片剂包肠溶衣常用的包衣物料是
A. 糖浆
B. 糖浆和滑石粉
C. 胶浆和滑石粉
D. 羟丙基甲基纤维素（HPMC）
E. 丙烯酸树脂Ⅱ号和Ⅲ号混合液

正确答案：E。丙烯酸树脂Ⅱ号和Ⅲ号混合液